服用滴丸应注意的事项有
A. 剂量不能过大
B. 宜研末服
C. 在保存中不宜受热
D. 有些可直接含于舌下
E. 宜少量温开水送服

正确答案：A、C、D、E。剂量不能过大；在保存中不宜受热；有些可直接含于舌下；宜少量温开水送服

解析：本题考查的是中成药特殊剂型的正确使用。服用滴丸应注意的事项有剂量不能过大（A对）、在保存中不宜受热（C对）、有些可直接含于舌下（D对）与宜少量温开水送服（E对）。滴丸：滴丸剂主要供口服用，多用于病情急重者，如冠心病、心绞痛、咳嗽、急慢性支气管炎等。服用滴丸时应注意：仔细阅读药物的服法，剂量不能过大；宜以少量温开水送服，有些可直接含于舌下；滴丸在保存中不宜受热。